急性肾小球肾炎的病理类型
A. 微小病变肾病
B. 新月体性肾小球肾炎
C. 硬化性肾小球肾炎
D. 系膜增生性肾小球肾炎
E. 毛细血管内增生性肾小球肾炎

正确答案：E。毛细血管内增生性肾小球肾炎

解析：急性肾小球肾的病变类型为毛细血管内增生性肾小球肾炎（E对）。新月体性肾小球肾炎是急进性肾小球肾炎的病理类型（B错）。微小病变肾病、硬化性肾小球肾炎、系膜增生性肾小球肾炎是肾病综合征的几种病理类型（ACD错）。